病毒性肝炎是孕妇哪种疾病的最常见原因
A. 妊娠期高血压
B. 产后出血
C. 妊娠期糖尿病
D. 黄疸
E. 子痫

正确答案：D。黄疸